对肌肉的支配，错误的是
A. 三角肌受腋神经支配
B. 旋前圆肌受正中神经支配
C. 肱三头肌受桡神经支配
D. 肱二头肌受肌皮神经支配
E. 手肌都由尺神经支配

正确答案：E。手肌都由尺神经支配

解析：正中神经、桡神经和尺神经共同支配手肌（E错，为本题正确选项）。